骨粉》中规定：干燥失重≤6.0g/100g，粒度通过率≥95%，铅≤2.0mg/kg，过氧化值≤0.25/100g，菌落总数限量为n＝5，c＝2，m＝10⁴CFU/g，M＝3×10⁴CFU/g。在该食品安全标准中，反映食品可能被污染及污染程度的指标是
A. 干燥失重
B. 粒度通过率
C. 铅
D. 过氧化值
E. 菌落总数

正确答案：E。菌落总数

解析：本题考查反映食品可能被污染及污染程度的指标。在该食品安全标准中，反映食品可能被污染及污染程度的指标是菌落总数（E对ABCD错）。菌落总数是指在被检样品的单位质量（g）、容积（ml）内，在严格规定的条件下（培养基及其pH、培育温度与时间、计数方法等）培养所形成的细菌菌落总数，以菌落形成单位（CFU）表示。